畸形中央尖X线检查可见
A. X线片上显示线样透射影，易被误认为副根管或双根管
B. X线表现为根尖周骨质有一圈致密骨白线围绕
C. X线片表现不断形成的牙本质将髓腔和根管过早地部分或完全的堵塞、闭锁
D. X线检查可见髓室顶中心有向（牙合）面中央部突起的畸形部分，并常见未发育完成呈喇叭形的根尖部
E. X线片示一个牙包于牙中，其实陷入部分的中央不是牙髓，而是含有残余成釉器的空腔

正确答案：D。X线检查可见髓室顶中心有向（牙合）面中央部突起的畸形部分，并常见未发育完成呈喇叭形的根尖部

解析：畸形中央尖X线检查可见髓室顶中心有向（牙合）面中央部突起的畸形部分，并常见未发育完成呈喇叭形的根尖部。掌握“牙内陷”知识点。